既温中益气，又缓急止痛的中成药是
A. 胃舒片
B. 胃得安片
C. 胃苏颗粒
D. 胃疡灵颗粒
E. 六味安消散

正确答案：D。胃疡灵颗粒

解析：本题考查的是胃疡灵颗粒的功能。既温中益气，又缓急止痛的中成药是胃疡灵颗粒（D对）。胃疡灵颗粒：【功能】温中益气，缓急止痛。胃苏颗粒（C错）：【功能】理气消胀，和胃止痛。六味安消散（E错）：【功能】和胃健脾，消积导滞，活血止痛。胃舒片（A错）与胃得安片（B错）的功能，2022年考试指南未明确说明。